第一次卫生革命的任务是
A. 预防和控制传染病
B. 心脑血管疾病和肿瘤
C. 促进人类健康长寿
D. 医学社会化
E. 发展初级卫生保健

正确答案：A。预防和控制传染病